有机磷农药毛果芸香碱中毒可见
A. 皮肤潮湿
B. 皮肤青紫
C. 皮肤干燥
D. 皮肤黏膜桃红色
E. 皮肤黏膜潮红

正确答案：A。皮肤潮湿

解析：有机磷农药毛果芸香碱中毒具体症状有恶心、呕吐、腹痛、腹泻、多汗、皮肤潮湿（A对）、流泪、流涕、流涎、尿频、大小便失禁、心跳减慢和瞳孔缩小、支气管痉挛和分泌物增加、咳嗽、气急，严重患者出现肺水肿。面、眼睑、舌、四肢和全身横纹肌发生肌纤维颤动，甚至全身肌肉强直性痉挛。头晕、头痛、烦躁不安、共济失调、抽搐、谵妄和昏迷等症状，患者可因呼吸衰竭和缺氧死亡。中毒机制是毛果芸香碱刺激M型胆碱能受体，促进汗腺、泪腺、胃肠道和呼吸腺的分泌，刺激各种平滑肌，抑制心血管系统等。